仰卧位时，前腹壁与胸骨下端到耻骨联合的连线大致在同一水平面上，称为
A. 腹部平坦
B. 腹部饱满
C. 腹部膨隆
D. 腹部低平
E. 腹部凹陷

正确答案：A。腹部平坦

解析：仰卧位时，前腹壁与胸骨下端到耻骨联合的连线大致在同一水平面上.称为腹部平坦（A对）。腹部饱满（B错）的特点是前腹壁略高于胸骨下端到耻骨联合的连线。腹部膨隆（C错）的特点是平卧时前腹壁明显高于肋缘与耻骨联合的平面，外观呈凸起状。腹部低平（D错）的特点是前腹壁稍低于胸骨下端到耻骨联合的连线。腹部凹陷（E错）的特点是仰卧时前腹壁明显低于肋缘与耻骨联合的平面。